国务院公布施行《突发公共卫生事件应急条例》的时间是
A. 1988年2月
B. 1989年2月
C. 2002年5月
D. 2003年5月
E. 2003年9月

正确答案：D。2003年5月

解析：本题考查国务院公布施行《突发公共卫生事件应急条例》的时间。国务院公布施行《突发公共卫生事件应急条例》的时间是2003年5月（D对ABCE错）9日。该条例将突发公共卫生事件定义为：突然发生，造成或者可能造成社会公众健康严重损害的重大传染病疫情、群体不明原因疾病、重大食物和职业中毒以及其他严重影响公众健康的事件。